非法吸食麻醉药品的，应
A. 由其所在单位给予行政处分
B. 由公安机关依照治安管理处罚条例或有关规定给予处罚
C. 由司法机关追究刑事责任
D. 没收全部麻醉药品和非法收入，并视情节给予罚款等处罚
E. 以生产、贩卖毒品罪论处

正确答案：B。由公安机关依照治安管理处罚条例或有关规定给予处罚